某女，40岁。既往患尿路感染，时而发作。清明时节，因感风热，不但诱发旧疾而且引发咳嗽。经治表证已解，但见尿频、尿急、尿痛、尿色红赤、咳嗽、气急、痰黄。治当利尿通淋、凉血止血、清肺止咳，宜选用的药是
A. 石韦
B. 通草
C. 翟麦
D. 海金沙
E. 车前子

正确答案：A。石韦

解析：本题考查石韦的功效。治当利尿通淋、凉血止血、清肺止咳，宜选用的药是石韦（A对）。石韦【功效】利尿通淋，凉血止血，清肺止咳。【主治病证】（1）血淋，热淋，石淋。（2）血热之崩漏、尿血、吐血、衄血。（3）肺热咳喘。通草（B错）【功效】利水清热，通气下乳。【主治病证】（1）湿热淋证。（2）湿温证，水肿尿少。（3）产后乳汁不下。翟麦（C错）【功效】利尿通淋，破血通经。【主治病证】（1）热淋，血淋，石淋。（2）瘀血闭经。海金沙（D错）【功效】利尿通淋，止痛。【主治病证】（1）热淋，血淋，石淋，膏淋。（2）水肿。车前子（E错）【功效】利水通淋，渗湿止泻，明目，清肺化痰。【主治病证】（1）湿热淋证，小便不利，水肿兼热。（2）暑湿水泻。（3）肝热目赤肿痛，肝肾亏虚之目暗不明（配补肝肾药）。（4）肺热咳嗽痰多。